抗原抗体反应的特异性主要依赖于
A. 抗原的相对分子质量
B. 抗体的电荷
C. 抗原和抗体的浓度
D. 抗原和抗体的构象
E. 免疫球蛋白的类别

正确答案：D。抗原和抗体的构象